宫颈糜烂的分度依据
A. 糜烂深度
B. 糜烂形状
C. 糜烂面积
D. 糜烂位置
E. 糜烂性质

正确答案：C。糜烂面积

解析：子宫颈外口处的子宫颈阴道部外观呈细颗粒状的红色区，称为宫颈糜烂样改变。以往的教科书称为“宫颈糜烂”，并认为是慢性宫颈炎的最常见病理改变（八年制第2版妇产科学P278）。宫颈糜烂的分度依据糜烂面积（C对）。轻度子宫糜烂是指糜烂面小于整个宫颈面积的1/3；中度指糜烂面占整个宫颈面积的1/3～2/3；重度指糜烂面占整个宫颈面积2/3以上。随着阴道镜的发展及对宫颈病理生理认识的提高，“宫颈糜烂”这一术语不再恰当。